颅底内面观看不到的孔是
A. 圆孔
B. 卵圆孔
C. 棘孔
D. 茎乳孔
E. 破裂孔

正确答案：D。茎乳孔

解析：颅底内面观看不到的孔是茎乳孔（D对），颅内面可见的是圆孔（A错）、卵圆孔（B错）、棘孔（C错）、破裂孔（E错）。